医务人员在医疗活动中发生医疗事故争议，应当立即向
A. 所在科室报告
B. 所在医院医务部门报告
C. 所在医疗机构医疗质量监控部门报告
D. 所在医疗机构的主管负责人报告
E. 当地卫生行政机关报告

正确答案：A。所在科室报告

解析：医务人员在医疗活动中发生医疗事故争议，应当立即向所在科室负责人报告（A对）。